患者，男，48岁。头胀痛近2年，时作时止，伴目眩易怒，面赤口苦，舌红苔黄，脉弦数。治疗除取主穴外，还应选用的穴位是
A. 头维、内庭、三阴交
B. 血海、风池、足三里
C. 风池、列缺、太阳
D. 太溪、侠溪、太冲
E. 丰隆、太阳、风门

正确答案：D。太溪、侠溪、太冲

解析：题中患者以头胀痛近两年且时作时止为主症，故诊断为头痛；目眩易怒，面赤口苦，舌红苔黄，脉弦数均为肝阳上亢之象，故辨为肝阳头痛。三阴交无治疗头痛的功效（A错）。血海、风池、足三里用于治疗血虚头痛（B错）。风池、列缺、太阳用于治疗外感头痛（C错）。太溪能治疗头痛、目眩、失眠、健忘等肾虚证，肾虚水不涵木可致肝阳上亢。侠溪可治疗头痛、眩晕、耳鸣、耳聋目赤肿痛等头面五官病。太冲可治疗头痛、眩晕、耳鸣、目赤肿痛等肝经风热病。故治疗头痛除选主穴外还可选太溪、侠溪、太冲（D对）。丰隆、太阳、风门可治疗外感头痛兼有痰者（E错）。